根据《疫苗流通和预防接种管理条例》，疫苗批发企业可以将第二类疫苗销售给
A. 疾病预防控制机构
B. 接种单位
C. 其他疫苗批发企业
D. 疫苗零售企业
E. 药品零售连锁企业

正确答案：A、B、C。疾病预防控制机构；接种单位；其他疫苗批发企业

解析：本题考查疫苗流通和预防接种管理。根据《疫苗流通和预防接种管理条例》，疫苗批发企业可以将第二类疫苗销售给疾病预防控制机构（A对）、接种单位（B对）、其他疫苗批发企业（C对）。第二类疫苗由省级疾病预防控制机构组织在省级公共资源交易平台集中采购。接收第一类疫苗或者购进第二类疫苗，英纳格索要疫苗储存、运输过程的温度监测记录，建立并保存真实、完整的接收、购进记录，做到票、账、货、款一致。药品零售企业不得从事疫苗经营活动（DE错）。